男，28岁。胸闷气促3年，支气管激发试验阳性。剧烈运动后气促加重，应用沙丁胺醇气雾剂吸入后可缓解症状。其主要作用机制是
A. 抑制嗜酸粒细胞聚集
B. 对抗过敏介质的作用
C. 舒张支气管平滑肌
D. 抑制肥大细胞释放过敏介质
E. 减少支气管黏液分泌

正确答案：C。舒张支气管平滑肌

解析：沙丁胺醇选择性激动β2受体，舒张支气管平滑肌（C对），用于哮喘、其他原因的支气管痉挛，喘息型支气管炎及COPD伴喘息的治疗。